具有敛肺止咳功效的药物是
A. 肉豆蔻
B. 赤石脂
C. 乌梅
D. 莲子
E. 芡实

正确答案：C。乌梅

解析：本题主要考查乌梅的功效。乌梅酸、涩，平。归肝、脾、肺、大肠经，具有敛肺止咳（C对），涩肠止泻，安蛔止痛，生津止渴的功效。肉豆蔻具有涩肠止泻，温中行气的功效（A错）。赤石脂具有涩肠止泻，收敛止血，敛疮生肌的功效（B错）。莲子具有益肾固精，补脾止泻，止带，养心安神的功效（D错）。芡实具有益肾固精，健脾止泻，除湿止带的功效（E错）。